女，72岁，胃癌根治术后第6天，出现上腹剧烈疼痛，逐渐加重，伴恶心，呕吐，腹胀，腹腔引流管引出咖啡色浑浊液体。查体：腹膜刺激征（+）。腹部B超提示腹腔积液。针对该病人，非手术中最重要的措施是
A. 低压灌肠
B. 止痛
C. 胃肠减压
D. 洗胃
E. 抗生素治疗

正确答案：C。胃肠减压

解析：患者出现吻合口瘘后继发急性腹膜炎，此时患者必须禁食（D错），并留置胃管持续胃肠减压（C对A错），抽出胃肠道内容物和气体以减少消化道内容物继续流入腹腔，减轻胃肠内积气，改善胃壁的血运，有利于炎症的局限和吸收，促进胃肠道恢复蠕动；止痛治疗（B错）只能作为暂时的对症治疗，对病情的预后无太大的作用；抗生素治疗应配合手术治疗原发灶和清除腹腔内积液才能发挥最大的作用（E错），而单纯的抗生素治疗不能代替引流等外科处理。